促使水中次氯酸含量保持较高水平的措施是
A. 提高pH
B. 降低pH
C. 提高水温
D. 降低水温
E. 降低浑浊度

正确答案：B。降低pH

解析：本题考查促使水中次氯酸含量保持较高水平的措施。次氯酸是弱电解质，在水中按下式离解：HOCl⇄H⁺＋OCl⁻。其离解程度与水温和pH有关。当pH＜5.0时，水中HOCl达100%，随着pH的增高，HOCl逐渐减少。要促使水中次氯酸含量保持较高水平，则需降低pH（B对ACDE错）。